a-葡萄糖苷酶抑制剂最常见的不良反应
A. 腹胀和腹泻
B. 肝功能异常
C. 肾功能异常
D. 严重低血糖
E. 过敏和水肿

正确答案：A。腹胀和腹泻

解析：a-葡萄糖酐酶抑制剂（如阿卡波糖）（P355）最常见的不良反应是胃肠道反应，如腹胀和腹泻（A对）。肝功能异常（B错）、过敏（E错）是磺酰脲类的常见不良反应，严重低血糖（D错）是磺酰脲类较严重的不良反应（P353）。